使用营养强化剂的要求是
A. 可以提高食品的营养价值
B. 可以使人群营养素摄入过量
C. 可以引起脂肪代谢异常
D. 不应改变食品的色泽
E. 不应改变食品的气味

正确答案：A。可以提高食品的营养价值

解析：本题考查使用营养强化剂的要求。营养强化剂常为必需氨基酸类、维生素类、矿物质类等。使用营养强化剂的要求是可以提高食品的营养价值（A对BCDE错）。